韦克斯勒智力测验组成主要是
A. 推理与思维测验
B. 表达与心理测验
C. 行为与思维测验
D. 言语与操作量表测验
E. 词汇与动作测验

正确答案：D。言语与操作量表测验

解析：国际上通用的智力测验有比奈量表（B-S）、韦氏量表（ W-S）和考夫曼儿童能力成套测验（K-ABC）等。韦氏量表包括成人（16岁以上）、儿童（6～16岁）和学龄前期（4～6岁）三个年龄版本。韦氏成人智力量表中国修订本称“中国修订韦氏成人智力量表（WAIS-RC）”，全量表 （FS）共含11个分测验，其中6个分测验组成言语量表（VS），5个分测验组成操作量表（PS）（D对）。